胎怯的病变脏腑主要在
A. 脾、肾
B. 心、肝
C. 心、肾
D. 心、脾
E. 肝、肾

正确答案：A。脾、肾

解析：该题主要考查胎怯的病变脏腑，理解记忆即可。胎怯的病变脏腑主要在脾、肾，发病机理为化源未充，濡养不足，肾脾两虚。因肾藏精，为生长发育之本，而先天之精又赖后天之精不断滋养才能得以充实（A对）。